2002年，美国公共卫生学会正式提出"公共卫生伦理实践的原则"共
A. 6条
B. 8条
C. 10条
D. 12条
E. 16条

正确答案：D。12条

解析：2002年，美国公共卫生学会正式提出12条"公共卫生伦理实践的原则"，这些原则指明了公共卫生的性质与特点、公共卫生机构及其从业人员的责任和义务、公共卫生方案和政策应遵循的核心价值和理念等。掌握“公共卫生伦理含义、理论基础与原则”知识点。